患者，女，42岁。既往有风湿热史。活动气急5年，伴夜间睡眠时阵发性干咳半年，X线提示梨形心。确诊风心病二尖瓣狭窄还必须有的诊断依据是
A. 二尖瓣开放拍击音
B. 二尖瓣区隆隆样舒张中晚期杂音
C. 奔马律
D. Graham-Steell 杂音
E. 二尖瓣面容

正确答案：B。二尖瓣区隆隆样舒张中晚期杂音

解析：二尖瓣区隆隆样舒张中晚期杂音为二尖瓣狭窄特征性杂音，故确诊风心病二尖瓣狭窄还必须有的诊断依据是二尖瓣区隆隆样舒张中晚期杂音（B对）。二尖瓣开放拍击音可见于二尖瓣狭窄，出现二尖瓣开放拍击音说明瓣膜本身尚有一定弹性，如果二尖瓣严重纤维增厚或钙化，则此音消失，故二尖瓣狭窄患者不一定出现二尖瓣开放拍击音（A错）。奔马律可见于健康的成年人及儿童（C错）。Graham-Steell 杂音见于肺动脉瓣关闭不全（D错）。二尖瓣面容可见于二尖瓣狭窄及二尖瓣关闭不全（E错）。